以往被称为牙源性钙化囊肿的牙源性钙化囊性瘤，病变的好发部位为
A. 上颌前磨牙区
B. 下颌前磨牙区
C. 上颌磨牙区
D. 下颌磨牙区
E. 上颌前牙区

正确答案：A。上颌前磨牙区

解析：牙源性钙化囊性瘤以往被称为牙源性钙化囊肿。患者多为10～19岁。上颌前磨牙区多见，病变多较为局限，有时也可发生于颌骨外的软组织内。掌握“牙源性钙化上皮、囊性瘤”知识点。